属于红细胞周围环境异常所致的溶血性贫血的是
A. 遗传性球形细胞增多症
B. PNH
C. 自身免疫性溶血性贫血
D. 海洋性贫血
E. 血红蛋白病

正确答案：C。自身免疫性溶血性贫血

解析：溶血性贫血按病因可分为红细胞自身异常所致的溶血性贫血（HA）和红细胞外部异常所致的溶血性贫血。红细胞周围环境异常所致的溶血性贫血包括1.免疫性HA：自身免疫性溶血性贫血（C对）、同型免疫性溶血性贫血；2.血管性HA：微血管病性HA，行军性血红蛋白尿等；3.蛇毒等生物因素引起的HA；4.理化因素引起的HA等。遗传性球形细胞增多症（A错）、阵发性睡眠性血红蛋白尿（PNH）（B错）、地中海贫血（又称海洋性贫血）（D错）、血红蛋白病S（E错）属于红细胞自身异常引起的溶血性贫血。